在胶囊剂的空胶囊壳中可加入少量的二氧化钛作为
A. 抗氧剂
B. 防腐剂
C. 遮光剂
D. 增塑剂
E. 保湿剂

正确答案：C。遮光剂

解析：本题考查片剂的包衣。遮光剂（C对）多为二氧化钛，常加入空胶囊壳中，提高对光的稳定性；抗氧剂（A错）指可以延缓或者抑制药物氧化的物质；防腐剂（B错）指具有抑菌作用，能抑制微生物生长繁殖的物质；增塑剂（D错）为改变高分子薄膜，增加其可塑性的物质；保湿剂（E错）主要有蒸馏水和乙醇。